根据《关于改革完善短缺药品供应保障机制的实施意见》，我国改革完善短缺药品供应保障机制的基本原则是
A. 实时预警、分级应对、集中釆购、零差率销售
B. 分级应对、分类管理、差异化经营、保障供应
C. 实时预警、委托生产、集中采购、统一配送
D. 分级应对、分类管理、会商联动、保障供应

正确答案：D。分级应对、分类管理、会商联动、保障供应

解析：本题考查的是改革完善短缺药品供应保障机制的基本原则。根据《关于改革完善短缺药品供应保障机制的实施意见》，我国改革完善短缺药品供应保障机制的基本原则是分级应对、分类管理、会商联动、保障供应（D对）。根据《关于改革完善短缺药品供应保障机制的实施意见》，我国将按照“分级应对、分类管理、会商联动、保障供应”的原则，建立短缺药品信息收集和汇总分析机制，完善短缺药品监测预警和清单管理制度，建设基于大数据应用的国家药品供应保障综合管理平台和短缺药品监测预警信息系统，健全部门会商联动机制，建立国家、省、地市、县四级监测预警机制和国家、省两级应对机制。